以下哪项符合绝对禁食
A. 急性胰腺炎早期
B. 急性糜烂出血性胃炎
C. 慢性透壁性溃疡
D. 持续潜血阳性
E. 肝性脑病昏迷

正确答案：A。急性胰腺炎早期

解析：急性胰腺炎早期为了降低胰液分泌，减少胰酶对胰腺的自身消化，就需要短期禁食（A对）。急性糜烂出血性胃炎（B错）、慢性透壁性溃疡（C错）、持续潜血阳性（D错）一般都不提倡进行绝对禁食。肝性脑病昏迷患者应当尽可能保持热量供应，防止低血糖（E错）。